某弱酸性药物的pKa是3.4，在血浆中的解离百分率约为
A. 1%
B. 10%
C. 9%
D. 99%
E. 99.99%

正确答案：E。99.99%

解析：[A⁻]/[HA]=10^（PH-pKa）=10^（7.4-3.4）=10⁴=10000：1（血浆中的pH为7.4），所以，解离百分率=（[A⁻]）/（[A⁻]+[HA]）=10000/10001=99.99%（E对）。